患儿，10个月。高热烦躁，气急鼻煽，张口抬肩，喉中痰鸣，声如拽锯，口唇发绀。其治法是
A. 清热宣肺，涤痰定喘
B. 清热解毒，止咳化痰
C. 辛凉开肺，清热化痰
D. 清热活血，泻肺化痰
E. 泻肺镇咳，清热化痰

正确答案：A。清热宣肺，涤痰定喘

解析：题中患儿以高热烦躁，气急鼻煽，张口抬肩，喉中痰鸣为主症，故诊断为肺炎喘嗽，小儿哮喘无高热的症状。高热烦躁为痰热胶结，肺气闭阻所致，肺气闭阻，宣肃失司，故气急鼻煽，张口抬肩，喉中痰鸣，声如拽锯，肺气闭塞，气机不利，则血流不畅，故口唇发绀，故辨为痰热闭肺证，治宜清热涤痰，开肺定喘（A对）。清热解毒，止咳化痰用于治疗有毒热的证型（B错）。辛凉开肺，清热化痰为肺炎喘嗽风热闭肺证的治法（C错）。题中无血热血瘀的症状（D错）。泻肺镇咳，清热化痰主治咳嗽痰热重者（E错）。